患者，32岁。咳嗽频剧，咳声嗄哑，咳痰不爽，痰稠黄，喉燥咽痛，口渴，鼻流黄涕，头痛，肢楚，恶风身热；舌边尖红，苔薄黄，脉浮数。诊断为咳嗽，辨析其证候是
A. 风寒袭肺证
B. 痰湿蕴肺证
C. 风燥伤肺证
D. 痰热郁肺证
E. 风热犯肺证

正确答案：E。风热犯肺证

解析：本题考查咳嗽之风热犯肺证。诊断为咳嗽，辨析其证候是风热犯肺证（E对）。咳嗽之风热犯肺证【症状】咳嗽频剧，气粗，或咳声嗄哑，咳痰不爽，痰黏稠或稠黄，喉燥咽痛，口渴，鼻流黄涕，头痛，肢楚，恶风身热。舌边尖红，苔薄黄，脉浮数。咳嗽之风寒袭肺证（A错）【症状】咳嗽声重，气急，咽痒，咳痰稀薄色白，常伴鼻塞，流清涕，头痛，肢体酸楚，或见恶寒、发热、无汗等风寒表证。舌苔薄白，脉浮或浮紧。咳嗽之痰湿蕴肺证（B错）【症状】咳嗽反复发作，咳声重浊，痰黏腻，或稠厚成块，痰多易咳，早晨或食后咳甚痰多，进甘甜油腻物加重，胸闷脘痞，呕恶，食少，体倦，大便时溏。舌苔白腻，脉滑。咳嗽之风燥伤肺证（C错）【症状】干咳，连声作呛，咽痒，咽喉干痛，唇鼻干燥，口干，无痰或痰少而黏，不易咳出，或痰中带血丝，初起或伴鼻塞、头痛、微恶寒、身热。舌质红而少津，苔薄白或薄黄，脉浮数。咳嗽之痰热郁肺证（D错）【症状】咳嗽，气息粗促，或喉中有痰声，痰多，质黏稠色黄，或有腥味，难咳，胸胁胀满，或咳时引痛，面赤，或有身热，口干而黏，欲饮水。舌红，苔黄腻，脉滑数。